缺牙区牙槽嵴愈合良好方可制作固定义齿，固定桥制作应在拔牙后
A. 半月
B. 1月
C. 3月
D. 6月
E. 1年

正确答案：C。3月

解析：本题考查缺牙区的牙槽嵴。缺牙区牙槽嵴愈合良好方可制作固定义齿，固定桥制作应在拔牙后3月（C对），因为一般来说，缺牙区的牙槽嵴在拔牙或手术后3月完全愈合。过早修复的话，牙槽嵴的吸收还未稳定，易引起修复后固定桥及基牙的不稳定，过晚修复的话，由于牙槽骨失去了生理性刺激，吸收速度会加快，不利于邻牙及咬合的稳定。而牙槽嵴修整术应在拔牙术后1月（B错）进行。